抗肿瘤药环磷酰胺的结构属于
A. 乙酰亚胺类
B. 亚硝基脲类
C. 氮芥类
D. 叶酸类
E. 嘧啶类

正确答案：C。氮芥类

解析：本题考查氮介类抗肿瘤药。环磷酰胺属于氮芥类（C对）抗肿瘤药。氮芥类药物是通过在体内转变成乙撑亚胺中间体发挥烷化剂作用，乙撑亚胺的磷酰胺衍生物，可提高抗肿瘤作用及减小毒性。